根据《中国药典》，只可外用，不可内服的毒性中药是
A. 红粉
B. 雄黄
C. 斑蝥
D. 蟾酥
E. 轻粉

正确答案：A。红粉

解析：本题考查的是部分毒性中药品种的用法用量。根据《中国药典》，只可外用，不可内服的毒性中药是红粉（A对）。红粉的用法用量：外用适量，研极细粉单用或与其他药味配伍成散剂或制成药捻。只可外用，不可内服。外用亦不宜久用；孕妇禁用。雄黄（B错）的用法用量：0.05～0.1g，入丸散用。外用适量，熏涂患处。注意事项：内服宜慎；不可久用；孕妇禁用。斑蝥（C错）的用法用量：内服，0.03～0.06g，多炮制后入丸散用。外用适量，研末或浸酒醋，或制油膏涂敷患处。注意事项：内服慎用，孕妇禁用，不宜大面积外用。蟾酥（D错）的用法用量：0.015～0.03g，多入丸散用。外用适量。注意事项：孕妇慎用。轻粉（E错）的用法用量：外用适量，研末掺敷患处。内服每次0.1～0.2g，一日1～2次，多入丸剂或装胶囊服，服后漱口。注意事项：不可过量；内服慎用；孕妇禁用。